在下颌骨内斜线的上方，颏棘两侧有
A. 翼腭窝
B. 颞下窝
C. 舌下腺窝
D. 下颌下腺窝
E. 关节翼肌窝

正确答案：C。舌下腺窝

解析：下颌体其内侧面近中线处有两对突起，上颏棘和下颏棘；上颏棘为颏舌肌的起点，下颏棘为颏舌骨肌的起点。自下颏棘斜向后上与外斜线相应的骨嵴称为内斜线（下颌舌骨线），为下颌舌骨肌起点；内斜线上方，颏棘两侧有舌下腺窝；内斜线下方，近下颌体下缘有下颌下腺窝和二腹肌窝。掌握“下颌骨及腭骨解剖特点”知识点。